通过增敏受体，发挥药效的药物是
A. 地塞米松
B. 罗格列酮
C. 普萘洛尔
D. 胰岛素
E. 异丙肾上腺素

正确答案：B。罗格列酮

解析：本题考查药物的作用与受体。通过增敏受体，发挥药效的药物是罗格列酮（B对）。增敏作用是指某药可使组织或受体对另一药的敏感性增强的作用。胰岛素增敏剂又称“胰岛素增敏因子”，它是过氧化物酶增殖体激活受体的激动剂，使细胞膜上胰岛素受体对胰岛素的敏感性增加，促进细胞对葡萄糖利用。地塞米松（A错）为强效糖皮质激素。普萘洛尔（C错）是具有氨基醇结构的β受体阻滞剂，为非选择性β-受体阻断药。胰岛素（D错）临床主要用于治疗高血糖。胰岛素可降低血糖水平。异丙肾上腺素（E错）为β受体激动剂。